下列关于横嵴的说法正确的是
A. 从后牙牙尖顶端伸向（牙合）面中央的细长形釉质隆起
B. 从牙尖顶端斜向近、远中的嵴
C. 前牙舌面窝的近远中边缘及后牙（牙合）面边缘的长条形釉质隆起
D. 牙冠表面细长形的釉质隆起
E. 相对牙尖的两条三角嵴，横过（牙合）面相连形成的嵴

正确答案：E。相对牙尖的两条三角嵴，横过（牙合）面相连形成的嵴

解析：横嵴：是相对牙尖的两条三角嵴，横过（牙合）面相连形成的嵴。掌握“牙的萌出、更替及牙体解剖名词、标志”知识点。